常用做需氧G+菌、G-球菌和厌氧球菌等感染的首选药，以及对β-内酰胺类抗生素过敏患者的替代品的抗生素是
A. 链霉素
B. 红霉素
C. 青霉素
D. 四环素
E. 庆大霉素

正确答案：B。红霉素

解析：大环内酯类抗生素疗效肯定，无严重不良反应，常用做需氧G+菌、G-球菌和厌氧球菌等感染的首选药，以及对伊内酰胺类抗生素过敏患者的替代品。掌握“红霉素及林可霉素”知识点。